男，31岁。双侧臀区交替性疼痛9年余，间断腰痛6年，疼痛主要发生在夜间，伴有晨僵。近3周症状加重，有夜间痛醒现象。查体：腰部活动受限，右侧“4”字试验阳性。实验室检查：血沉24mm/h，HLAB27（+）。最可能的诊断是
A. 腰椎间盘突出症
B. 类风湿关节炎
C. 腰椎肿瘤
D. 腰椎管狭窄症
E. 强直性脊柱炎

正确答案：E。强直性脊柱炎

解析：中年男性患者，双侧臀区交替性疼痛9年余，间断腰痛6年，疼痛主要发生在夜间，伴有晨僵。近3周症状加重，有夜间痛醒现象。查体：腰部活动受限，右侧“4”字试验阳性。实验室检查：血沉24mm/h（正常值成年男性0-15mm/h，成年女性0-20mm/h），HLAB27（+）。综合患者的症状、体征和辅助检查，最可能的诊断是强直性脊柱炎（E对）。腰椎间盘突出症（A错）无HLAB27（+）。类风湿关节炎（B错）以女性居多，很少有骶髂关节病变，只侵犯颈椎，有类风湿结节，与HLA-DR4相关。腰椎肿瘤（C错）病人腰痛呈进行性加重，平卧不能减轻，恶性肿瘤有贫血和恶病质，碱性或酸性磷酸酶升高，X线平片显示骨破坏。腰椎管狭窄症（D错）临床上以下腰痛、马尾神经或腰神经受压症状为主要表现，以神经源性间歇性跋行为主要特点。